乳牙和年轻恒牙牙髓治疗前摄X线牙片的目的
A. 查看龋蚀相对深度，有无修复性牙本质
B. 根间区有无病变，年轻恒牙牙根发育程度
C. 乳牙根吸收程度，有无恒牙胚
D. 牙髓腔内有无钙化，有无内吸收
E. 以上均是

正确答案：E。以上均是

解析：本题考查乳牙和年轻恒牙牙髓治疗前摄X线牙片的目的。乳牙和年轻恒牙牙髓治疗前必须拍摄X线牙片，目的是：1.查看龋蚀相对深度，有无修复性牙本质（A对）；2.根间区有无病变，年轻恒牙牙根发育程度（B对）；3.乳牙根吸收程度，有无恒牙胚（C对）；4.牙髓腔内有无钙化，有无内吸收（D对）；5.根尖周围组织病变的状况和程度；6.年轻恒牙牙胚发育状况及其牙囊骨壁有无受损。综上，以上均是（E对，为本题正确答案）乳牙和年轻恒牙牙髓治疗前摄X线牙片的目的。